男，52岁，近2个月来大便次数增多，有肛门坠胀感及里急后重，大便变细，常有粘液血便，经抗生素治疗症状可缓解，但不久又复发，且呈进行性加重。首先应进行的检查是
A. 直肠指诊
B. 钡灌肠检查
C. 腹部CT
D. 直（乙状结）肠镜检
E. B超检查

正确答案：A。直肠指诊

解析：患者老年男性，有肛门坠胀感及里急后重（直肠刺激症状），大便变细（大便变形），且有血便，症状呈进行性加重（符合直肠癌的典型临床表现），拟诊断为直肠癌。直肠指诊是诊断直肠癌最重要的方法，首先应进行的检查是直肠指诊（A对）。钡灌肠检查（B错）是结肠癌的重要检查方法，对直肠癌诊断意义不大。腹部CT（C错）是术前常用的检查方法，有助于了解直肠癌的扩散情况。直（乙状）结肠镜检（D错）一般在直肠指检阳性，需取活组织时采用。B超（E错）对肛管直肠部位成像不佳，不宜采用。